暴发调查中常用的测量指标是
A. 发病率
B. 患病率
C. 病死率
D. 死亡率
E. 罹患率

正确答案：E。罹患率